男，20岁，苍白、乏力一周。淋巴结及脾大，白细胞计数32.0×10⁹/L，骨髓中原始细胞占83%，过氧化物酶染色阴性。如果出现头痛，时有呕吐，脑脊液压力增高，脑脊液可见少量幼稚细胞，应加用的治疗是
A. 脾切除术
B. 输血小板悬液
C. 控制感染
D. 白细胞去除术
E. 鞘内注射甲氨蝶呤

正确答案：E。鞘内注射甲氨蝶呤

解析：患者诊断为急性淋巴细胞白血病（ALL），如果患者出现头痛，时有呕吐，脑脊液压力增高，脑脊液可见少量幼稚细胞，提示并发中枢神经系统白血病（中枢神经系统是白血病最常见的髓外浸润部位，急性淋巴细胞白血病易并发中枢神经系统白血病），此时应加用的治疗为颅脊椎照射、鞘内注射化疗药（如MTX（甲氨喋呤）（E对）、Ara-C、糖皮质激素）和（或）高剂量的全身化疗药（如HD MTX、Ara-C）。脾切除术（A错）用于脾亢、遗传性球形细胞增多症等的治疗，对中枢神经系统白血病无效；输血小板悬液（P574）（B错）用于治疗血小板过低引起的出血；控制感染（P574）（C错）用于粒细胞减少或缺乏导致感染的白血病患者的对症治疗；白细胞去除术（P574）（D错）用于高白细胞血症的治疗。